超声波洁牙机工作头的前端与牙石接触的角度宜小于
A. 90°
B. 80°
C. 60°
D. 45°
E. 15°

正确答案：E。15°

解析：本题考查超声波龈上洁治。龈上洁治术及龈下刮治术是指用洁治器械去除龈上下牙石、菌斑等，以延迟菌斑牙石的再沉积，包括手动洁治和超声洁治。超声洁治时，工作头的前端与牙石接触的角度宜小于15°（E对），利用超声震动击碎并振落牙石。接触角大于15°时（ABCD错），会损害超声工作头，不利于工作头的维护。